根据《药品广告审查发布标准》，如在药品广告中出现下列宣传用语，可以直接确定其属于药品虚假宣传的是
A. “改善睡眠”
B. “应在专业人员指导下使用”
C. “传统中药”
D. “改善肠道功能”
E. “使用3个疗程治愈糖尿病”

正确答案：E。“使用3个疗程治愈糖尿病”

解析：本题考查药品虚假宣传和虚假交易行为。根据《药品广告审查发布标准》，如在药品广告中出现下列宣传用语，可以直接确定其属于药品虚假宣传的是“使用3个疗程治愈糖尿病”（E错，为本题正确答案）。虚假宣传和虚假交易行为：经营者不得对其商品的性能、功能、质量、销售状况、用户评价、曾获荣誉等作虚假或者引人误解的商业宣传，欺骗、误导消费者。经营者不得通过组织虚假交易等方式，帮助其他经营者进行虚假或者引人误解的商业宣传。通过虚假交易生成不真实的销量数据、用户好评的“刷单炒信”，会对消费者的购物决策产生严重误导，新修订的《反不正当竞争法》将其定性为虚假商业宣传。